患儿，男，1岁。患婴幼儿腹泻2天，泻下急迫，大便呈稀水蛋花样，有粘液及腥臭味，伴阵发啼哭，发热，烦躁，口渴，困倦，小便短赤，肛门灼热，发红。其证型是
A. 伤食
B. 风寒
C. 脾虚
D. 湿热
E. 脾肾阳虚

正确答案：D。湿热

解析：患儿以大便性质异常为主症，故诊断为腹泻。湿热之邪，蕴结肠胃，下注大肠，传化失职，故见泻下急迫，大便呈稀水蛋花样；湿性黏腻，热性急迫，湿热交蒸，壅遏肠胃气机，不通则痛，故见黏液及腥臭味，伴阵发啼哭；湿热困脾，则困倦；若伴有外感者，可见发热，其热重于湿者，则见烦躁，口渴，小便短赤，肛门灼热，发红，故其证候为湿热泻，治以清肠解热，化湿止泻，方药为葛根黄芩黄连汤加减（D对）。伤食泻临床以便稀夹有不消化食物，气味酸臭，脘腹胀痛，泻后痛减为临床特征（A错）。风寒泻临床以大便清稀夹有泡沫，臭气不甚，肠鸣腹痛为临床特征（B错）。脾虚泻临床以大便稀溏，色淡不臭，多于食后作泻，时轻时重，腹胀纳呆为临床特征（C错）。脾肾阳虚泻临床以大便澄澈清冷，完谷不化，形寒肢冷为临床特征（E错）。